小儿，晨起喷嚏，流涕，继而发热，晚间头面、躯干见稀疏细小皮疹，疹色淡红。精神倦怠，治疗应首选方剂
A. 桑菊饮
B. 银翘散
C. 葱豉汤
D. 清营汤
E. 杏苏散

正确答案：B。银翘散

解析：风疹是其皮疹特点为多数病人发热1～2天后出疹，皮疹呈多形性，多为散在淡红色斑丘疹，也可呈大片皮肤发红或针尖状猩红热样皮疹。先见于面部，迅速由面部、颈部、躯干波及四肢，躯干皮疹稀疏，面部及四肢往往融合，24小时内波及全身，一般历时3天，疹退后无脱屑或留有细小脱屑，但无色素沉着。本病例患儿急性起病，皮疹特点淡红色细小皮疹，稀疏分布于头面、躯干，符合风疹的临床表现，故诊断为风疹。外感风热，邪在肺卫，故见喷嚏，流涕，发热等肺卫症状；晚间头面、躯干见稀疏细小皮疹，疹色淡红，此为风热之邪随疹外透的表现，故其证型为邪郁肺卫证，治以疏风解表透疹，方药为银翘散（B对）。桑菊饮（A错）其功用为疏风清热，宣肺止咳，适用于风热咳嗽。葱豉汤（C错）其功用为通阳发汗，适用于外感初起。清营汤（D错）其功用为清营解毒，透热养阴，适用于热入营分证。杏苏散（E错）其功用为清宣凉燥，理肺化痰，适用于外感凉燥证。